具有行气导滞、攻积泄热功用的方剂是
A. 舟车丸
B. 保和丸
C. 枳实消痞丸
D. 木香槟榔丸
E. 枳实导滞丸

正确答案：D。木香槟榔丸

解析：本题考查方剂的功效，属记忆内容。木香槟榔丸主治，积滞内停，湿蕴生热。功用行气导滞、攻积泄热（D对）。记忆：木香槟榔青陈皮，黄柏黄连莪枳齐。大黄黑丑兼香附，热滞泻痢皆相宜。趣记：用茯苓，三黄二皮，（一）只鹅（枳莪）。